蒙药传统剂型有
A. 丸剂
B. 膏剂
C. 散剂
D. 酒剂
E. 油剂

正确答案：A、B、C、D、E。丸剂；膏剂；散剂；酒剂；油剂

解析：本题考查的是蒙药的传统剂型。蒙药传统剂型有丸剂（A对）、膏剂（B对）、散剂（C对）、酒剂（D对）与油剂（E对）。蒙药的传统剂型有8种。1.汤剂（汤散）；2.散剂；3.丸剂；4.膏剂；5.灰剂；6.油剂。此外还有搅全剂与酒剂，现已不常用。